贵重药材、毒剧药材及高浓度制剂药材的提取应采用
A. 煎煮法
B. 浸渍法
C. 渗漉法
D. 水蒸气蒸馏法
E. 超临界流体提取法

正确答案：C。渗漉法